患者肢体痿软，身体困重，手足麻木，发热，喜凉恶热，胸痞脘闷，小便赤涩热痛，舌苔黄腻，脉滑数。其治疗宜选用
A. 清燥救肺汤
B. 二妙丸
C. 虎潜丸
D. 参苓白术散
E. 白虎加人参汤

正确答案：B。二妙丸

解析：患者肢体痿软，诊断为痿证。湿热浸淫经脉，气血阻滞，故肢体痿软；湿热浸渍肌肤，故见身体困重；湿热不攘，气血运行不畅，故见手足麻木；湿热郁蒸，气机不化，可见发热，喜凉恶热；湿阻气机，故胸脘痞闷；湿热下注，故小便赤涩热痛；可辨证为湿热浸淫证。治法宜清热利湿，通利筋脉；方选二妙丸（B对）。清燥救肺汤功用清燥润肺，益气养阴，可用于治疗痿证肺热津伤证（A错）。虎潜丸可用于治疗痿证肝肾亏损证（C错）。参苓白术散功效益气健脾，渗湿止泻，可用于治疗痿证脾胃虚弱证（D错）。白虎加人参汤功效清热益气生津，主治气分热盛，气津两伤证（E错）。